其中检验数据结果符合标准规定的项目有
A. 薄层色谱
B. 杂质
C. 含量测定
D. 水分
E. 有机氯农药残留量

正确答案：A、B、D。薄层色谱；杂质；水分

解析：本题考查西洋参的鉴别。其中检验数据结果符合标准规定的项目有薄层色谱（A对）、杂质（B对）、水分（D对）。西洋参【理化鉴别】取本品甲醇提取液作为供试品溶液，以西洋参对照药材和拟人参皂苷FⅡ、人参皂苷Rb，、人参皂苷Re、人参皂苷Rg，对照品作对照。供试品色谱中，在与对照药材色谱及对照品色谱相应的位置上，分别显相同颜色的斑点或荧光斑点。【检查】杂质不得过0.5%，总灰分不得过5.0%，水分不得过13.0%。农药残留量（E错）：总六六六不得过0.2mg/kg；总滴滴涕不得过0.2mg/kg；五氯硝基苯不得过0.1mg/kg；六氯苯不得过0.1mg/kg；七氯（七氯、环氧七氯之和）不得过0.05mg/kg；艾氏剂不得过0.05mg/kg；氯丹不得过0.1mg/kg。【含量测定（C错）】按《中国药典》采用高效液相色谱法测定，本品含人参皂苷Rg1、人参皂苷Re和人参皂苷Rb1，的总量不得少于2.0%。